胆碱酯酶复活剂不具备的药理作用是
A. 恢复已经老化的胆碱酯酶活性
B. 解除烟碱样症状
C. 恢复被抑制的胆碱酯酶活性
D. 与阿托品合用可发挥协同作用
E. 增高全血胆碱酯酶活性

正确答案：A。恢复已经老化的胆碱酯酶活性

解析：胆碱酯酶复活剂（氯解磷定）能恢复被抑制的胆碱酯酶的活力（C对），提高全血胆碱酯酶活性（E对），但对中毒24-48小时后已老化的胆碱酯酶无复活作用（A错，为本题正确答案）。此外，胆碱酯酶复活剂还能作用于外周N2受体，对抗外周N胆碱受体活性，有效解除烟碱样症状（B对）。与解除M样症状的阿托品合用，可发挥协同作用（D对）。